衡量有毒物质接触程度或健康效应尺度的是
A. 职业接触限值
B. 时间加权平均容许浓度
C. 最高容许浓度
D. 短时间接触容许浓度
E. 生物接触限值

正确答案：E。生物接触限值